在复发性阿弗他溃疡的全身治疗中，正确使用肾上腺皮质激素类药物的方法是
A. 泼尼松10～30mg/d，分3次口服，溃疡控制后逐渐减量
B. 泼尼松60mg/d，分3次口服，控制病情后减量
C. 泼尼松60～80mg/d，分3次口服，控制病情后减量
D. 泼尼松80～100mg/d，分3次口服，控制病情后减量
E. 泼尼松100～120mg/d，分3次口服，控制病情后减量

正确答案：A。泼尼松10～30mg/d，分3次口服，溃疡控制后逐渐减量

解析：本题考查复发性阿弗他溃疡的全身治疗。在复发性阿弗他溃疡的全身治疗中，正确使用肾上腺皮质激素类药物的方法是泼尼松10～30mg/d，分3次口服，溃疡控制后逐渐减量（A对）。复发性阿弗他溃疡的全身治疗中泼尼松片的使用：泼尼松片，每片5mg，开始时每10～30mg，每日3次等量服用；或采取“晨高暮低法”，即早晨服用全日总剂量的3/4或2/3，午后服用1/4或1/3；或采用“隔日疗法”，即将2天的总剂量在隔日早晨机体糖皮质激素分泌高峰时一次顿服，可以提高药效。待溃疡控制后逐渐减量，每3～5日减量一次，每次按20%左右递减，维持量为每日5～10mg。当维持量已减至其正常基础需要量（每日5～7.5mg）以下，视病情稳定即可停药。